水解后可与三氯化铁反应用于鉴别的是
A. 阿司匹林
B. 庆大霉素
C. 苯巴比妥
D. 硫喷妥钠
E. 司可巴比妥

正确答案：A。阿司匹林

解析：本题考查常用的药品鉴别方法。阿司匹林（A对）加水煮沸使水解生成水杨酸后，可与三氯化铁试液反应显紫堇色，常用于鉴别。庆大霉素（B错）、苯巴比妥（C错）及硫喷妥钠（D错）水解不产生酚羟基，与三氯化铁不发生反应。司可巴比妥（E错）具有还原性，常用碘试剂进行鉴别，使碘试剂褪色。